男性，47岁。因电击伤致心脏骤停，经初级复苏后转入病房。首选应检查
A. 脑功能
B. 肾功能
C. 循环功能
D. 肝功能
E. 肺泡通气

正确答案：C。循环功能

解析：电击伤最主要的损害器官是心脏，该患者曾经发生心脏骤停，故经初级复苏后首先应检查循环功能（C对）。循环功能对维持于全身各组织器官的灌流，保证复苏后组织氧供应至关重要。脑功能（A错）、肾功能（B错）、肝功能（D错）和呼吸功能（E错）在患者复苏后应予以关注，但不作为该患者的首选检查。